同时刺激多种感官的游戏和运动，称为
A. 平衡的有氧运动
B. 充分的健康教育
C. 感觉整合训练
D. 早期语言训练
E. 学龄前教育

正确答案：C。感觉整合训练

解析：感觉整合训练即感觉统合训练，是指基于儿童的神经需要，引导对感觉刺激作适当反应的训练，此训练提供前庭（重力与运动）、本体感觉（肌肉与感觉）及触觉等刺激的全身运动，其目的不在于增强运动技能，而是改善脑处理感觉资讯与组织并构成感觉资讯的方法。因此同时刺激多种感官的游戏和运动，称为感觉整合训练（C对）。